伤寒流行时对被污染的水源进行消毒属于
A. 一级预防
B. 二级预防
C. 三级预防
D. 传染病的预防措施
E. 传染病的防疫性措施

正确答案：E。传染病的防疫性措施

解析：本题考查传染病的防疫性措施。伤寒流行时对被污染的水源进行消毒属于传染病的防疫性措施（E对ABCD错）。